与月经后期和月经过少的发病均有关的是
A. 血热
B. 血虚
C. 血瘀
D. 血寒
E. 湿热

正确答案：B。血虚

解析：素体血虚，或久病伤血，营血亏虚，或饮食、劳倦、思虑伤脾，脾虚化源不足，冲任血海不充，遂月经量少；体质虚弱，营血不足，或久病失血，或产育过多，耗伤阴血，或脾气虚弱，化源不足，均可致阴血亏虚，冲任不充，血海不能按时满溢遂致月经后期（B对）。血热分为阳盛血热，热扰冲任、胞宫，迫血下行；阴虚血热，热伏冲任，血海不宁或肝气郁结，郁而化热，迫血下行，可致月经先期或月经过多（A错）。血瘀可致月经过少，不会导致月经后期（C错）。血寒致血行不畅，导致月经后期，不会导致月经过少（D错）。湿热多导致带下病（E错）。